适用于人工流产负压吸引术的妊娠时间是
A. 妊娠12周
B. 妊娠18周
C. 妊娠6周
D. 妊娠24周
E. 妊娠30周

正确答案：C。妊娠6周

解析：负压吸引术是手术流产的方法之一，是终止早期妊娠的人工流产方法。负压吸引术是利用负压吸引原理，将妊娠物从宫腔内吸出，适应于妊娠10周内要求终止妊娠及无禁忌证者、妊娠10周内因患某种疾病不宜继续妊娠者（C对）。